男，35岁。纳差、腹胀2个月。查体：浅表淋巴结未触及，巩膜无黄染，肝肋下未触及，脾肋下8.5cm，质硬。化验血常规：Hb100g/L，WBC67.7×10⁹/L，原始细胞0.02，早幼粒细胞0.02，中幼粒细胞0.13，晚幼粒细胞0.18，杆状核粒细胞0.08，分叶粒细胞0.37，E0.06，B0.09，L0.04，M0.01，Plt543×10⁹/L。该患者最可能的染色体改变是
A. t（8：16）（p11：p13）
B. t（9：22）（q34：q11）
C. t（9：21）（q34：q21）
D. t（8：21）（q22：q22）
E. t（15：17）（q22：q21）

正确答案：B。t（9：22）（q34：q11）

解析：患者纳差、腹胀2个月，查体脾肋下8.5cm，质硬。化验血常规：WBC67.7×10⁹/L，原始细胞0.02，早幼粒细胞0.02，中幼粒细胞0.13，晚幼粒细胞0.18，杆状核粒细胞0.08，分叶粒细胞0.37，E0.06，B0.09，L0.04，M0.01，Plt543×10⁹/L，考虑慢性髓系白血病（CML）。慢性髓系白血病慢性期一般持续1～4年，病人有乏力、低热、多汗或盗汗、体重减轻等代谢亢进的症状，由于脾大而自觉有左上腹坠胀感。常以脾大为最显著体征，往往就医时已达脐或脐以下，质地坚实，平滑，无压痛。血象白细胞数明显增高，常超过20×10⁹/L，血片中粒细胞显著增多，可见各阶段粒细胞，以中性中幼、晚幼和杆状核粒细胞居多；原始 （Ⅰ+Ⅱ）细胞＜10%；嗜酸性、嗜碱性粒细胞增多，血小板可在正常水平，近半数病人增多。细胞遗传学及分子生物学检查发现95%以上的CML细胞中存在Ph染色体（小的22号染色体），显带分析为t（9；22）（q34；q11）（B对）。t（8：16）（p11：p13）（A错）、t（8：21）（q22：q22）（D错）和t（15：17）（q22：q21）（E错）是AML常见的染色体异常。